角化囊肿属于
A. 发育性颌骨囊肿
B. 血外渗性囊肿
C. 牙源性颌骨囊肿
D. 胚胎性颌骨囊肿
E. 炎症性颌骨囊肿

正确答案：C。牙源性颌骨囊肿

解析：颌骨囊肿可根据组织来源和发病部位而分类。由成牙组织或牙的上皮或上皮剩余演变而来的，称为牙源性颌骨囊肿。牙源性角化囊性瘤（牙源性角化囊肿）系来源于原始的牙胚或牙板残余；有人认为即始基囊肿，但不能解释角化囊肿也可以含牙；其内容角化物质也与始基囊肿多为清亮液体不同。掌握“牙源性颌骨囊肿”知识点。